夜间阵发性呼吸困难，高枕卧位，颈静脉怒张，双肺底可闻及干湿啰音，肝大，下肢水肿，诊断考虑是
A. 全心衰竭
B. 急性左心衰竭
C. 慢性右心衰竭
D. 慢性左心衰竭
E. 急性右心衰竭

正确答案：A。全心衰竭

解析：夜间阵发性呼吸困难，高枕卧位，双肺底可闻及干湿啰音（左心衰竭导致肺循环淤血的典型表现），颈静脉怒张，肝大，下肢水肿（右心衰竭导致体循环淤血的典型表现），故诊断考虑是全心衰竭（A对CDE错）。急性左心衰竭（B错）典型表现为突发严重呼吸困难，强迫坐位，频繁咳嗽，咳粉红色泡沫状痰。